可用于治疗高血压
A. 麻黄碱
B. 伪麻黄碱
C. 二者均是
D. 二者均不是

正确答案：D。二者均不是